在商店出售的进口化妆品包装应有
A. 国家卫生计生委颁发的许可证
B. 出产国颁发的卫生质量证书
C. 进口商检报告编号
D. 省级以上卫生行政部门颁发的许可证
E. 疾病控制部门的检验合格证

正确答案：A。国家卫生计生委颁发的许可证

解析：本题考查商店出售的进口化妆品包装的要求。在商店出售的进口化妆品包装应有国家卫生计生委颁发的许可证（A对BCDE错）。